在血吸虫发育各阶段中，引起人体主要病理改变的是
A. 尾蚴
B. 成虫
C. 虫卵
D. 幼虫
E. 毛蚴

正确答案：C。虫卵

解析：在血吸虫发育各阶段中，引起人体主要病理改变的是虫卵（C对），虫卵沉着于乙状结肠、直肠和肝等处，形成虫卵结节，造成损害。尾蚴（A错）主要引起尾蚴性皮炎，表现为入侵局部瘙痒的小丘疹，数日后自然消退。成虫（B错）对机体的损害作用较轻。童虫（D错）可引起肺组织充血、水肿、点状出血及白细胞浸润，但病变一般轻微而短暂。